某患者，右下6远中舌侧大面积缺损，已进行根管治疗以后，现要求修复，检查发现右下6无叩痛，无松动，咬合距离正常，临床牙冠高度尚可，可以采用以下几种方法除了
A. 铸造金属全冠
B. 塑料全冠
C. 金属烤瓷全冠
D. 嵌体冠
E. 全瓷冠

正确答案：B。塑料全冠

解析：塑料全冠临床应用多作为暂时冠，起保护活髓，维持和稳定的作用。可暂时恢复功能。由于材料性能欠佳，不作为永久修复。掌握“牙体缺损修复体固位及适应、禁忌证”知识点。